临床上用于记录颌位关系的是
A. 基托
B. 暂基托
C. （牙合）堤
D. （牙合）托
E. 蜡基托

正确答案：D。（牙合）托

解析：本题考查颌位关系记录。临床上用于记录颌位关系的是（牙合）托（D对）。基托（A错）是全口义齿与黏膜紧密接触以提供固位力的部分。暂基托（B错）是全口义齿制作过程中，用蜡或树脂制成的暂时基托，接下来在暂基托的基础上制作（牙合）堤。（牙合）堤（C错）是用蜡制成的，以确定全口义齿的（牙合）平面。蜡基托（E错）是全口义齿制作过程中，试排牙后，在患者口内试戴以确定人工牙排列，颌位关系是否合适的部分。